全身最长的浅静脉是
A. 颈外静脉
B. 下腔静脉
C. 大隐静脉
D. 颈内静脉
E. 小隐静脉

正确答案：C。大隐静脉

解析：大隐静脉（C对）为全身最长的静脉。